女，56岁。右乳头间断血性溢液1年，触及肿物6个月，无疼痛不适。查体：T36.5℃.P80次／分，BP120/80mmHg，腋窝可触及成团融合并固定的淋巴结。心肺腹查体未见异常。右乳头轻度内陷，按压乳晕周围可见右乳头单孔少量血性溢液，右乳乳晕深面可及5.5cm×4cm包块，质硬，边界不清，与胸壁粘连固定。为明确诊断，最佳的检查方法是
A. 乳管镜检查
B. 乳头溢液涂片细胞学检查
C. 乳腺及腋窝超声
D. 乳腺肿物切除活检
E. 乳腺肿物穿刺活检

正确答案：D。乳腺肿物切除活检

解析：患者为56岁女性，右乳头间断血性溢液1年，触及无痛性肿块6个月，查体可见右乳轻度内陷，按压乳晕周围可见右乳头单孔少量血性溢液，右乳乳晕深面可及5.5cm×4cm包块，质硬，边界不清，活动性差，腋窝可触及成团融合并固定的淋巴结，综合该患者的临床表现，考虑为乳腺癌的可能性较大。为明确诊断，应进行病理组织活检，由于该患者考虑乳腺癌可能性较大，因此最佳选择乳腺肿物切除活检（D对E错），乳管镜检查（A错）和乳头溢液涂片细胞学检查（B错）应用于乳头溢液但未扪及肿块者，乳腺及腋窝超声（C错）适用于致密型乳腺病变的评价、囊性病变的检查和观察血供情况以对定性诊断提供有价值的依据。